现有企业生产车间噪声容许标准可放宽至
A. 80dB（A）
B. 85dB（A）
C. 90dB（A）
D. 100dB（A）
E. 115dB（A）

正确答案：C。90dB（A）